黄体功能不足
A. 经前诊刮子宫内膜分泌不足
B. 经期第5天子宫内膜为混合型
C. 经前诊刮子宫内膜呈增殖期
D. 经前诊刮子宫内膜为分泌期
E. 子宫内膜为蜕膜

正确答案：A。经前诊刮子宫内膜分泌不足

解析：黄体功能不足：一般表现为月经周期缩短，有时月经周期虽在正常范围内，但卵泡期延长、黄体期缩短，以致患者不易受孕或在孕早期流产。子宫内膜形态一般表现为分泌期内膜腺体分泌不良，内膜活检显示分泌反应落后2日。掌握“功能失调性子宫出血”知识点。